男性，58岁，进行性贫血，消瘦乏力半年，有时右腹隐痛，无腹泻。查体：右中腹部扪及肿块，肠鸣音活跃。如果需要手术治疗，术前准备最重要的是
A. 纠正营养
B. 肠道准备
C. 心肺功能检查
D. 肝肾功能检查
E. 心理准备

正确答案：B。肠道准备

解析：结肠癌手术属于消化道手术，因此患者术前准备中最重要的是肠道准备（B对），可以有效预防术后并发症；纠正营养（A错）、心肺肝肾功能检查（CD错）、心理准备（E错）均为所有患者的一般术前准备，无特异性。